四个样本率比较进行卡方检验，其自由度为
A. 1
B. 2
C. 3
D. 4
E. 5

正确答案：C。3

解析：题为多个样本率比较χ²检验的自由度计算，其中四个样本率比较，数据表应为4行2列，故χ²检验的自由度=（行数-1）×（列数-1）=（4-1）×（2-1）=3（C对）。